猩红热出现皮疹多在发热后
A. 12小时之内
B. 12～48小时
C. 60～72小时
D. 84～96小时
E. 大于96小时

正确答案：B。12～48小时

解析：链球菌的红疹毒素使皮肤血管充血、水肿，上皮细胞增生，白细胞浸润，以毛囊周围最明显，形成典型的猩红热样皮疹。猩红热出现皮疹多在发热后24小时内（12～48小时）（B对）开始发疹，多数情况下，皮疹于48小时达高峰，然后按出诊顺序开始消退，2～3天内退尽，但重者可持续1周左右。